长期学习负荷过重引起的慢性疲劳称为
A. 疲劳
B. 早期疲劳
C. 显著疲劳
D. 疲倦
E. 过劳

正确答案：E。过劳